对病人的高度责任心和对药学事业的献身精神是
A. 药学职业道德的权利
B. 药学职业道德的义务
C. 药学职业道德的节操
D. 药学职业道德的良心
E. 药学职业道德的情感

正确答案：B。药学职业道德的义务